患者女性，35岁，二尖瓣狭窄，呼吸困难伴咯血3天，双肺底少许水泡音，心脏正侧位片可见淤血，首选的治疗措施是
A. 氨苯蝶啶
B. 吸氧
C. 可待因
D. 西地兰
E. 硝酸甘油或硝酸异山梨酯

正确答案：E。硝酸甘油或硝酸异山梨酯

解析：硝酸甘油或硝酸异山梨酯可作用于血管平滑肌的特异受体，小剂量异山梨酯扩张静脉，大剂量可扩张动脉和静脉，从而使心肌收缩力增强，而心腔内舒张压的减轻可使心内膜下冠状动脉的阻力也下降，从而改善心肌本身血供，心力衰竭得到纠正（E对）。氨苯蝶啶，用于治疗各类水肿，如心力衰竭、肝硬化及慢性肾炎引起的水肿和腹水，以及糖皮质激素治疗过程中发生的水钠潴留（A错）。吸氧用于纠正缺氧，提高动脉血氧分压和氧饱和度的水平，促进代谢，是辅助治疗多种疾病的重要方法之一。如呼吸衰竭，慢性气管炎，脑血管病，冠心病（B错）。可待因用于各种原因引起的剧烈干咳和刺激性咳嗽，尤适用于伴有胸痛的剧烈干咳者。由于本品能抑制呼吸道腺体分泌和纤毛运动，故对有少量痰液的剧烈咳嗽，应与祛痰药并用。有镇痛作用，可用于中等度疼痛（C错）。西地兰用于急性和慢性心力衰竭、心房颤动和阵发性室上性心动过速（D错）。